脑死亡标准由美国哈佛大学医学院特设委员会首先提出的时间是
A. 1958年
B. 1968年
C. 1978年
D. 1988年
E. 1998年

正确答案：B。1968年

解析：1968年，美国哈佛大学医学院特设委员会提出了“脑死亡”诊断标准。掌握“安乐死与死亡伦理”知识点。